补充酪氨酸可“节省”体内的
A. 苯丙氨酸
B. 组氨酸
C. 蛋氨酸
D. 赖氨酸
E. 亮氨酸

正确答案：A。苯丙氨酸